患者高热3天，头痛，伴呕吐；检查：颈项强直，克氏征阳性，脑脊液外观混浊，细胞数2000/μl，以中性粒细胞为主。应首先考虑的是
A. 结核性脑膜炎
B. 流行性脑脊髓膜炎
C. 流行性乙型脑炎
D. 伤寒
E. 中毒型菌痢

正确答案：B。流行性脑脊髓膜炎

解析：流行性脑脊髓膜炎主要临床表现是突发高热、剧烈头痛、频繁呕吐，皮肤黏膜瘀点、瘀斑及脑膜刺激征，严重者可有败血症休克和脑实质损害，常可危及生命。部分患者暴发起病，可迅速致死。本病经呼吸道传播，冬春季多见。全球分布，呈散发或流行，儿童发病率高。患者高热，头痛伴呕吐且颈项强直，克氏征阳性，脑脊液外观混浊，可明确诊断为流行性脑脊髓膜炎（B对）。结核性脑膜炎季节性，多有结核病史。起病较缓，病程长，脑膜刺激征明显，脑实质病变表现较轻。脑脊液中氯化物与糖均降低，蛋白质升高较明显，薄膜涂片或培养可检出结核杆菌。X线胸片及眼底检查，可能发现结核灶（A错）。流行性乙型脑炎临床特征为高热、意识障碍、抽搐及病理征阳性等，重症者可发生中枢性呼吸衰竭，病死率高，部分患者遗留不同程度的后遗症（C错）。伤寒以持续高热、全身中毒症状、玫瑰疹、相对缓脉、肝脾肿大和血白细胞减少等临床表现为特征，严重者可出现肠出血或肠穿孔等并发症（D错）。中毒型菌痢在儿童多见，夏秋季节发病，突起高热、反复惊厥、意识障碍、循环衰竭和（或）呼吸衰竭表现者，均应考虑中毒型菌痢（E错）。